婴儿，女，出生7天，啼哭拒食。口腔黏膜出现微凸的软白小点，擦去后可露出出血点，拟诊为
A. 白斑
B. 早期乳牙
C. 白色念珠菌病
D. 角化上皮珠
E. 疱疹性口炎

正确答案：C。白色念珠菌病

解析：本题考查口腔念珠菌病。婴儿，女，出生7天，啼哭拒食。口腔黏膜出现微凸的软白小点，擦去后可露出出血点，拟诊为白色念珠菌病（C对）。该婴儿出生7天，黏膜上有软白小点，啼哭拒食，擦去白点可暴露出血点，患儿的临床表现符合急性假膜型念珠菌口炎（白色念珠菌病）的临床特点。白斑（A错）好发于40岁以上的中老年男性，其所形成白色损害不能擦去。牙胚破龈而出的现象称为出龈，牙冠突破口腔黏膜时会在口腔黏膜上表现为一个白点，此白点实质上是早期乳牙（B错），该白点无法被擦去。角化上皮珠（D错）是婴儿出生后不久，偶见牙龈上出现针头大小的白色突起，俗称马牙，一般不影响进食，可自行脱落。疱疹性口炎（E错）的损害表现为有成簇的小水疱，疱破后成为大片表浅溃疡，而患者口腔内无水疱出现。